胃切除术后呕吐的原因不包括
A. 胃排空障碍
B. 输入袢梗阻
C. 吻合口梗阻
D. 输出袢梗阻
E. 晚期倾倒综合征

正确答案：E。晚期倾倒综合征

解析：晚期倾倒综合征（E错，为本题正确答案）主要表现为头晕、面色苍白、出冷汗、乏力等低血糖症状，为食物进入肠道后刺激胰岛素大量分泌所致，不会出现呕吐。胃排空障碍（A对）、吻合口梗阻（B对）、输出襻梗阻（D对）均会影响胃肠内容物的排空从而引起呕吐。输入袢梗阻（C对）由于输入段肠管内的消化液排空障碍，进食后消化液分泌增多，输入段肠管内压力增高并刺激肠管收缩，可引起呕吐。